食品卫生监督员执行以下任务，但除外
A. 可以向食品生产经营者了解情况
B. 可以向食品生产经营者索取必要的资料
C. 进入生产经营场所检查
D. 按照规定无偿采样
E. 办理食品卫生许可证

正确答案：E。办理食品卫生许可证